关于支原体的生物学性状，错误的是
A. 高度多形性
B. 可通过细菌过滤器
C. 有独特生活周期
D. 无细胞壁
E. 菌落呈油煎荷包蛋型

正确答案：C。有独特生活周期

解析：本题考查支原体的生物学性状。有独特的生活周期（B错，为本题的正确答案）可见于衣原体。支原体是一类无细胞壁（D对）、呈高度多形态性（A对）、能通过滤菌器（B对）、可用人工培养基培养的最小原核细胞型微生物，在琼脂含量较少的固体培养基上可呈典型的“油煎蛋”样菌落（E对）。